不属于精神分裂症阳性症状的是
A. 言语性幻听
B. 影响妄想
C. 思维破裂
D. 思维贫乏
E. 紧张性木僵

正确答案：D。思维贫乏

解析：根据八版精神病学：阳性症状包括（1）幻觉：幻听（A对）、幻视、幻嗅、幻味；（2）妄想（B对）；（3）瓦解症状群：包括思维形式障碍和思维过程障碍、怪异行为和紧张症行为。思维形式障碍按严重程度由轻到重可表现为病理性赘述、思维散漫离题、思维破裂（C对）及词的杂拌等。思维过程障碍包括思维奔逸、思维阻滞、思维贫乏（D对）等。紧张症行为表现为紧张性木僵和紧张性兴奋交替出现或单独发生（E对）。所以根据八版精神病学，本题五个选项都属于精神分裂症阳性症状，本题无正确答案，原答案为D。